出现脓尿和菌尿的疾病是
A. 溶血性黄疸
B. 肝细胞性黄疸
C. 急性肾小球肾炎
D. 泌尿系结石
E. 膀胱炎

正确答案：E。膀胱炎

解析：脓尿和菌尿:新排出的尿液外观混浊，因尿内含有大量白细胞、炎性渗出物或细菌所致…菌尿呈云雾状，静置后不下沉；脓尿放置后可见白色絮状沉淀。此两种尿液不论加热、加酸，其混浊均不消失。见于泌尿系统感染，如肾盂肾炎、膀胱炎、尿道炎等（E对）。溶血性黄疸表现为血红蛋白尿，多呈酱油色或者茶色（A错）。肝细胞性黄疸由于尿内含有大量结合胆红素，呈深黄色，振荡后泡沫亦呈黄色（B错）。急性肾小球肾炎其特点为急性起病，血尿、蛋白尿、水肿和高血压（C错）。尿路结石主要症状是疼痛及血尿。通常患者都会出现肉眼或镜下血尿，后者更为常见（D错）。